厌氧菌引起的肺炎宜选用
A. 氟康唑
B. 万古霉素
C. 克林霉素
D. 阿奇霉素
E. 头孢哌酮

正确答案：C。克林霉素

解析：本题考查肺炎治疗药。克林霉素（C对）可治疗厌氧菌引起的肺炎。氟康唑（A错）主要用于抗真菌。万古霉素（B错）可治疗对甲氧西林耐药的葡萄球菌引起的肺炎。阿奇霉素（D错）用于支原体、衣原体引起的肺炎。头孢哌酮（E错）主要治疗铜绿假单胞菌所致的肺炎。